肺痈患者，咳吐大量脓血痰，气味腥臭异常，舌红苔黄腻，脉滑数。其病期是
A. 初期
B. 成痈期
C. 溃脓期
D. 恢复期
E. .慢性期

正确答案：C。溃脓期

解析：通过了解痰的量、色、质、味的变化及临床表现，辨其病程所属。初期痰白或黄，量少，质黏，无特殊气味，出现恶寒、发热、咳嗽等肺卫表证（A错）；成痈期痰呈黄绿色，量多，质黏稠，有腥臭，出现高热、振寒、咳嗽、气急、胸痛等痰热痪毒蕴肺的证候（B错）；溃脓期表现为排出大量腥臭脓痰或脓血痰，质如米粥，气味腥臭异常（C对）；恢复期痰色较黄，量减少，其质清稀，臭味渐轻，若正气逐渐恢复，痈疡渐告愈合，若溃后脓毒不尽，邪恋正虚， 病情迁延（D错）。